有甲基萘醌结构，可用于新生儿出血的脂溶性维生素类药物是
A. 维生素A
B. 维生素D₂
C. 维生素D₃
D. 维生素E
E. 维生素K₁

正确答案：E。维生素K₁

解析：本题考查维生素K₁的结构和药理作用。维生素K₁（E对）为脂溶性维生素，有甲基萘醌结构，可用于新生儿出血。